克罗恩病的手术指征不包括
A. 肠内瘘
B. 慢性肠穿孔
C. 发热、腹痛、体重下降
D. 肠管狭窄
E. 持续出血

正确答案：C。发热、腹痛、体重下降

解析：发热、腹痛、体重下降是克罗恩病的常见临床表现，不是其手术指征（C错，为本题正确答案）。克罗恩病一般采用内科治疗，但对于肠内瘘（A对）或肠外瘘、慢性肠穿孔（B对）、肠管狭窄（D对）、长期持续出血（E对）、内科保守治疗无效者等需手术治疗。